下列病变中属于不可逆性改变的是
A. 细胞水肿
B. 线粒体膜破裂
C. 核碎裂
D. 线粒体肿胀
E. 粗面内质网脱颗粒

正确答案：C。核碎裂

解析：不可逆性改变（损伤）即细胞死亡，是指细胞发生的致死性代谢、结构和功能障碍。细胞坏死是细胞死亡的一种类型，因此其主要病变之一核碎裂（C对）属于不可逆性改变。线粒体肿胀（D错）是细胞水肿（A错）的主要病变特点，而细胞水肿属于可逆性损伤，当线粒体肿胀到一定程度时，表面积较小的外膜可能破裂（B错）。粗面内质网脱颗粒（E错）可见于中央性尼氏小体溶解（P327），属于神经元的基本病变。